某患儿，4岁半，腭裂修复术后，如腭咽闭合良好，多长时间可开始语音训练
A. 2周
B. 3周
C. 1个月
D. 3个月
E. 6个月

正确答案：C。1个月

解析：腭裂语音治疗的适应症：①手术后已获得良好的腭咽闭合者，否则，语音治疗一般无效。②即使咽成型术获得成功，但是由于病人不良发音习惯已经养成，各种代偿发音造成语音不清者均应该通过语音治疗给与纠正。③患儿能与语音治疗医师配合，年龄一般在4周以上，不合作者不宜接受语音训练。④治疗前要排除中等听力障碍，舌系带过短等影响训练的因素。⑤患儿智商要基本正常，严重弱智难以配合治疗，疗效很差。⑥符合以上条件者手术后1个月可开始语音训练。掌握“唇腭裂的序列治疗”知识点。